符合Ⅰ型呼吸衰竭的动脉血气标准是
A. PaO₂为50mmHg，PaCO₂为40mmHg
B. PaO₂为55mmHg，PaCO₂为51mmHg
C. PaO₂为65mmHg，PaCO₂为40mmHg
D. PaO₂为70mmHg，PaCO₂为40mmHg
E. PaO₂为70mmHg，PaCO₂为45mmHg

正确答案：A。PaO₂为50mmHg，PaCO₂为40mmHg

解析：本题考查Ⅰ型呼吸衰竭。符合Ⅰ型呼吸衰竭的动脉血气标准是PaO₂为50mmHg，PaCO₂为40mmHg（A对）。PaO₂为55mmHg，PaCO₂为51mmHg（B错）属于Ⅱ型呼吸衰竭。PaO₂为65mmHg，PaCO₂为40mmHg（C错）、PaO₂为70mmHg，PaCO₂为40mmHg（D错）、PaO₂为70mmHg，PaCO₂为45mmHg（E错）均属于轻度低氧血症。